溴隐亭治疗帕金森病的作用机制是
A. 激动中枢乙酰胆碱受体
B. 激动中枢多巴胺受体
C. 补充中枢多巴胺受体
D. 补充中枢乙酰胆碱受体
E. 抑制中枢脱羧酶

正确答案：B。激动中枢多巴胺受体

解析：本题考查溴隐亭的作用机制。溴隐亭属于多巴胺受体激动剂（B对），直接作用于多巴胺受体，对外周多巴胺受体也有微弱的激动作用。治疗帕金森病需要使用胆碱能受体抑制剂（AD错）。帕金森病治疗可以补充中枢多巴胺（C错）或抑制中枢脱羧酶（E错），代表药为左旋多巴及卡比多巴。